女性，20岁。左乳外上方圆形肿块，质地坚韧，表面光滑，活动度较好，边界清，无压痛。应首先考虑的诊断是
A. 乳癖
B. 乳核
C. 乳发
D. 乳痈
E. 乳癌

正确答案：B。乳核

解析：乳腺纤维腺瘤属中医“乳核”范畴，临床特点是乳房肿块，圆形，表面而光滑、质地坚韧、推之移动（B对）。乳腺增生的临床特点是乳房胀痛、乳房肿块及乳头溢液，属中医“乳癖”范畴（A错）。乳发指乳房或胸肌之内易于腐烂坏死的化脓性感染。其症初起即乳房（或胸部）焮热漫肿，并有较剧烈的疼痛，伴有恶寒发热，来势凶猛，发展迅速，皮肉焦黑腐烂。妇女常乳房遍溃，囊膈损伤（C错）。 急性乳腺炎的临床特点是乳房结块，红肿热痛。本病属中医“乳痛”范畴（D错）。乳腺癌临床见浸润性生长的无痛性乳腺肿块、与皮肤粘连、有乳头血性溢液、较大肿块引起乳腺皮肤水肿、橘皮样变、乳头回缩、患侧乳腺抬高等（E错）。